影响人类健康的因素分为四大类，下列哪项不属于这四大类
A. 生物学因素
B. 环境因素
C. 生态因素
D. 行为生活方式
E. 卫生服务

正确答案：C。生态因素